关于支气管哮喘发作体征描述错误的是
A. 非发作期可无异常体征
B. 哮喘发作时肺部可闻及哮鸣音
C. 危重患者可表现寂静胸
D. 胸腹矛盾运动
E. 心率降低

正确答案：E。心率降低

解析：非发作期可无异常体征。哮喘发作时肺部可闻及哮鸣音，呼气延长。危重患者肺部可满布哮鸣音，也可无哮鸣音，这种无哮鸣音体征又称为寂静胸，提示病情严重。中重度哮喘患者还可出现心率增快、奇脉、胸腹矛盾运动和发绀。掌握“支气管哮喘”知识点。